白头翁的功效是
A. 清热解毒，排脓消痈
B. 清热解毒，祛痰利咽
C. 清热解毒，凉血止痢
D. 清热解毒，祛风燥湿
E. 清热解毒，活血止痛

正确答案：C。清热解毒，凉血止痢

解析：本题考查的是白头翁的功效。白头翁的功效是清热解毒，凉血止痢（C对）。白头翁：【功效】清热解毒，凉血止痢。鱼腥草：【功效】清热解毒，排脓消痈（A错），利尿通淋。射干：【功效】清热解毒，祛痰利咽（B错），散结消肿。白鲜皮：【功效】清热解毒，祛风燥湿（D错），止痒。大血藤：【功效】清热解毒，活血止痛（E错），祛风通络。